男性，60岁。吸烟史30年，咳嗽咳痰20年，活动后气急5年，偶有下肢水肿。体检：桶状胸，两肺呼吸音低，少量湿罗音，肺动脉瓣区第二心音亢进。最可能的诊断是
A. 喘息型慢性支气管炎
B. 慢性支气管炎急性发作
C. 老年性肺气肿
D. 慢支、肺气肿、肺心病
E. 肺源性心脏病失代偿期

正确答案：D。慢支、肺气肿、肺心病